出现柏油样便，提示消化道出血量在
A. 5～20mL
B. 30～40mL
C. 50～70mL
D. 80～100mL
E. 120mL以上

正确答案：C。50～70mL

解析：出血量的估计：据研究，成人每日消化道出血＞5mL即可出现粪便隐血试验阳性（A错），每日出血量50～100mL可出现黑便（C对），胃内蓄积血量在250～300mL可引起呕血。